男性，38岁，1月来乏力、食欲差，左上腹胀痛。查体：肝肋下3cm，脾肋下10cm，血红蛋白70g/L，白细胞260×10⁹/L，血小板210×10⁹/L，白细胞分类：中性粒及晚幼粒细胞为主，中性粒细胞碱性磷酸酶活性减低，首选治疗
A. 羟基脲
B. 三代头孢
C. 脾切除
D. DA方案
E. 保肝治疗

正确答案：A。羟基脲

解析：患者中青年男性，1月来乏力、食欲差，左上腹胀痛。查体：肝肋下3cm，脾肋下10cm（慢性粒细胞白血病慢性期患者有乏力、低热、多汗等症状，常以脾脏肿大为显著体征，由于脾大自觉上腹胀痛，肝肿大常轻至中度肿大），血红蛋白70g/L（成年男性Hb正常值120～160g/L），提示贫血，白细胞260×10⁹/L（正常4～10×10⁹/L）大于200×10⁹/L，提示白细胞淤滞症（慢性粒细胞白血病白细胞可显著增高，发生“白细胞淤滞症”），血小板210×10⁹/L（正常100～300×10⁹/L）正常，白细胞分类：中性粒及晚幼粒细胞为主，中性粒细胞碱性磷酸酶活性减低（符合慢粒的血象特点），故考虑患者为慢性粒细胞白血病合并有白细胞淤滞症，现首选的治疗是给予羟基脲（A对）降白细胞处理。三代头孢（B错）主要用于感染性疾病的治疗；脾切除（C错）主要用于脾功能亢进、遗传性球形细胞增多症等的治疗，患者脾脏肿大显著是由白血病细胞浸润所致，无脾功能亢进表现，无需脾切除治疗；DA方案（P576）（D错）为急性髓系白血病的首选治疗方案；保肝治疗（E错）主要用于肝炎、肝硬化等的治疗。